大便秘结，胸胁痞满，多见于
A. 肝脾气郁
B. 热结肠胃
C. 津亏血燥
D. 阳虚寒凝
E. 气血两虚

正确答案：A。肝脾气郁

解析：本题考查的是便秘的辨证论治。大便秘结，胸胁痞满，多见于气秘（A对）。便秘是指粪便在肠内滞留过久，秘结不通，排便周期延长，或周期不长，但粪质干结，排出艰难，或粪质不硬，虽有便意，但排而不畅的疾病。西医学的功能性便秘、肠易激综合征、直肠肛门疾患引起的便秘、药物性便秘等，可参考此内容辨证论治。（一）热秘（B错）：【症状】大便干结，腹胀腹痛，口干口臭，面红心烦，或有身热，小便短赤。舌红，苔黄燥，脉滑数。（二）气秘：【症状】大便干结，或不甚干结，欲便不得出，或便出不爽，胸胁痞满，肠鸣矢气，腹中胀痛，嗳气频作，纳食减少。舌苔薄腻，脉弦。（三）冷秘（D错）：【症状】大便艰涩，腹痛拘急，胀满拒按，胁下偏痛，手足不温，呃逆呕吐。舌苔白腻，脉弦紧。（四）虚秘：【症状】大便并不干硬，虽有便意，但排便困难，用力努挣则汗出短气，便后乏力，面白神疲，肢倦懒言。舌淡苔白，脉弱。气血两虚（E错）证的临床表现及辨证要点：气血两虚证的临床表现，常见少气懒言，乏力自汗，面色苍白或萎黄，心悸失眠，舌淡而嫩，脉细弱等。多以气虚与血虚的症状同见为辨证要点。辨证为津亏血燥（C错）的疾病，2022年考试指南未明确说明。